住院患者开具的麻醉药品和第一类精神药品处方应当逐日开具，每张处方为几日常用量
A. 1天
B. 3天
C. 7天
D. 10天
E. 15天

正确答案：A。1天

解析：住院患者开具的麻醉药品和第一类精神药品处方应当逐日开具，每张处方为1日常用量。掌握“处方的开具、监督管理及法律责任”知识点。